男性，50岁。上前牙固定义齿4个月后修复体与邻牙间出现间隙。查：上11、21缺失，12～22瓷固定桥修复，上颌侧切牙与尖牙间隙0.5mm，12、22叩诊（+），不松动。余留牙正常。最可能的原因是
A. 基牙折断
B. 基牙负荷过大
C. 基牙牙周炎
D. 修复体制作问题
E. 固位体固位力不够

正确答案：B。基牙负荷过大

解析：该病例11、21缺失，12、22牙周膜面积小于缺失牙，基牙支持能力差，12～22固定桥修复使得基牙负荷过大，结果导致基牙及修复体唇向移位，与邻牙出现间隙，基牙叩痛是因为负荷过大，有咬合创伤。基牙不松动，也未发现其他问题，可排除基牙折断、牙周炎、修复体制作问题和固位的问题。掌握“固定桥的组成和分类”知识点。